牙暴露于口腔，露出于牙龈的部分
A. 牙冠
B. 牙骨质
C. 牙质
D. 牙龈
E. 牙周膜

正确答案：A。牙冠

解析：牙暴露于口腔，露出于牙龈的部分是牙冠(A对)。